墨旱莲的功效是
A. 滋补肝肾，益精明目
B. 滋补肝肾，凉血止血
C. 滋补肝肾，乌须明目
D. 补益肝肾，润肠通便
E. 凉血止血，化痰止咳

正确答案：B。滋补肝肾，凉血止血

解析：墨旱莲的功效是滋补肝肾，凉血止血（B对），可用于治疗肝肾阴虚证，阴虚血热的失血证。